男，42岁。平素无不适。体检时发现血压120/80mmHg，心率80次/分，律不齐。心电图示偶发室性期前收缩。超声心动图示心脏结构功能正常。目前该患者最适宜的处置是
A. 口服索他洛尔
B. 暂不治疗，随诊
C. 射频消融术
D. 口服美托洛尔
E. 口服胺碘酮

正确答案：B。暂不治疗，随诊

解析：患者男，42岁。平素无不适。体检时发现血压120/80mmHg，心率80次/分，律不齐，超声心电图示心脏结构功能正常，可判断无器质性病变。心电图示偶发室性期前收缩，正常人可发生室性期前收缩，无其他明显症状，不必使用药物治疗（B对）。